患者，男，39岁，反复鼻衄3个月，伴头痛，目眩，烦躁易怒，两目红赤，口苦，舌红，脉弦数，其治法是
A. 疏肝理气，活血化瘀
B. 疏肝理气，凉血止血
C. 清肝泻火，凉血止血
D. 清泻肝胆，活血化瘀
E. 清热解毒，宁络止血

正确答案：C。清肝泻火，凉血止血

解析：根据患者“反复鼻衄3个月”，辨为“鼻衄”，根据“伴头痛，目眩，烦躁易怒，两目红赤，口苦，舌红，脉弦数”，辨为“肝火上炎证”。患者火热上炎，迫血妄行，上溢清窍，治宜清肝泻火，凉血止血（C对），方选龙胆泻肝汤加减。